基础代谢率的正常范围是不超过正常平均值的
A. ±5%～±10%
B. ±0%～±5%
C. ±10%～±15%
D. ±20%～±30%
E. ±30%～±40%

正确答案：C。±10%～±15%